X线表现显示颌骨质弥漫性疏松，呈现斑点状、虫蚀状不规则破坏，且边界不清，有颌骨放疗史
A. 牙源性中央性颌骨骨髓炎
B. 牙源性边缘性颌骨骨髓炎
C. 颌骨放射性骨坏死
D. 双磷酸盐相关颌骨坏死
E. 牙源性上颌窦炎

正确答案：C。颌骨放射性骨坏死

解析：本题考查颌骨放射性骨坏死。X线表现显示颌骨质弥漫性疏松，呈现斑点状、虫蚀状不规则破坏，且边界不清，有颌骨放疗史为颌骨放射性骨坏死（C对）。颌骨放射性骨坏死X线表现：病变早期骨质弥漫性疏松，进而有不规则破坏，呈斑点状、虫蚀状、网格状改变，边界不清。